患者，男，16岁。突然出现咳嗽、喘憋半小时，咳呛阵作，气粗息涌，喉中哮鸣，面赤汗出，舌红苔黄腻，脉滑数。其治法是
A. 温肺散寒，化痰平喘
B. 补肾纳气平喘
C. 健脾化痰，止咳平喘
D. 清热宣肺，化痰平喘
E. 清热化痰肃肺

正确答案：D。清热宣肺，化痰平喘

解析：痰热壅肺，肺失清肃，肺气上逆，故突然出现咳嗽、喘憋半小时，咳呛阵作，气粗息涌，喉中哮鸣；肺热内伏，蒸液外出，故见面赤汗出；舌红苔黄腻，脉滑数，均为痰热壅肺的热哮证的表现，治法为清热宜肺，化痰定喘（D对）。温肺散寒，化痰平喘（A错）用于治疗寒哮证。补肾纳气平喘（B错）可以治疗缓解期肾虚证。健脾化痰，止咳平喘（C错）用于治疗脾虚证。清热化痰肃肺（E错）用于治疗肺热咳喘证。